强直性肌张力增高（铅管样强直）的病变部位在
A. 锥体外系
B. 锥体束
C. 小脑
D. 脊髓前角
E. 脑桥

正确答案：A。锥体外系

解析：肌张力是指静息状态下的肌肉紧张度和被动运动时遇到的阻力，强直性肌张力增高（铅管样强直）的病变部位在锥体外系（A对）。锥体束（B错）病变可出现折刀样张力过高。小脑（C错）病变可出现共济失调。脊髓前角（D错）病变可出现可出现运动系统功能异常。脑桥（E错）病变可出现呼吸节律。运动功能异常。